境外第一类医疗器械
A. 经省（区、市）药品监督管理部门审查，批准后发给注册证
B. 经国务院药品监督管理部门审查，批准后发给注册证
C. 经国务院药品监督管理部门备案
D. 经省（区、市）药品监督管理部门备案

正确答案：C。经国务院药品监督管理部门备案

解析：本题考查产品注册与备案管理。境外生产的第一类医疗器械应当向国家药品监督管理部门备案（C对）。产品注册与备案管理：国家建立医疗器械注册与备案管理工作体系和制度，应当注册而未经注册，或者应当备案而未经备案的医疗器械不得上市。第一类医疗器械备案，由备案人向所在地设区的市级药品监督管理部门提交备案资料（D错）。境内第二类医疗器械由注册申请人所在地省（区、市）药品监督管理部门审查（A错），批准后发给医疗器械注册证。境内第三类医疗器械由国务院药品监督管理部门审查，批准后发给医疗器械注册证。进口医疗器械，应当由境外生产企业作为注册申请人或者备案人，由其在我国境内设立的代表机构或者指定我国境内的企业法人作为代理人，申请注册或者办理备案。进口第一类医疗器械备案，境外备案人由其指定的我国境内企业法人向国务院药品监督管理部门提交备案资料和备案人所在国（地区）主管部门准许该医疗器械上市销售的证明文件。进口第二类、第三类医疗器械由国务院药品监督管理部门审查，批准后发给医疗器械注册证（B错）。